复发性外阴阴道假丝酵母菌病（RVVC）的维持治疗应持续
A. 1个月
B. 3天
C. 3个月
D. 6个月
E. 7～14天

正确答案：D。6个月

解析：复发性外阴阴道假丝酵母菌病（RVVC），是指一年内有症状并经真菌学证实的VVC（外阴阴道假丝酵母菌病）发作4次或以上；其抗真菌治疗分为初始治疗及巩固治疗，在初始治疗达到真菌学治愈后，给予巩固治疗至半年，即6个月（D对）。